下列何神经损伤导致前臂不能旋后
A. 腋神经
B. 肌皮神经
C. 正中神经
D. 桡神经
E. 无

正确答案：D。桡神经

解析：腋神经（A错）损伤导致三角肌瘫痪，此时表现为臂不能外展，肩部和臂外上部皮肤感觉障碍，由于三角肌萎缩，病人肩部亦失去圆隆的外形。肌皮神经（B错）损伤后表现为屈肘无力以及前臂外侧部皮肤感觉的减弱。正中神经（C错）损伤表现为该神经所支配的肌收缩无力和手掌感觉障碍，使臂不能旋前。桡神经（D对）分布于前臂伸肌群、桡尺远侧关节、腕关节和掌骨间关，损伤后导致臂不能旋后。